根据《药品经营质量管理规范》及其有关附录文件，属于保温箱特有的验证项目是
A. 测点终端安装数量及位置确认
B. 测点终端参数与数据联动传输确认
C. 运输最长时限验证
D. 极端温度保温性能验证

正确答案：C。运输最长时限验证

解析：本题考查的是药品经营质量管理规范附录文件《验证管理》。根据《药品经营质量管理规范》及其有关附录文件，属于保温箱特有的验证项目是运输最长时限验证（C对）。冷藏箱（保温箱）验证项目包括：箱内温度分布特性，蓄冷剂配备使用（蓄冷剂与保温箱采取摆列组合式捆绑验证），测点终端位置，开箱作业对箱内温度影响，极端温度保温性能，运输最长时限验证。测点终端安装数量及位置确认（A错）为温湿度自动监测系统特有的验证项目。极端温度保温性能验证（D错）为冷库、冷藏车、保温箱共有的验证项目。